全口义齿合适的磨光面可以
A. 有助于义齿的稳定
B. 避免咬颊咬舌
C. 提高咀嚼效率
D. 使发音清楚
E. 增加面颊部丰满度

正确答案：A。有助于义齿的稳定

解析：磨光面：磨光面是义齿与唇、颊、舌侧软组织和肌肉接触的表面。磨光面的外形是由不同的斜面构成的，磨光面的倾斜度、义齿周围边缘的宽度和人工牙颊舌位置正常时，舌和颊侧组织有帮助义齿固位和抵抗侧向压力的作用。掌握“无牙颌的解剖标志及功能分区”知识点。